用于皮肤消毒的洗必泰液浓度为
A. 0.001
B. 0.003
C. 0.004
D. 0.005
E. 0.01

正确答案：D。0.005

解析：本题考查用于皮肤消毒的洗必泰液浓度。氯己定溶液又称洗必泰液，为广谱消毒剂，刺激性小，故使用广泛，皮肤消毒浓度为0.5％（D对），以0.5％氯己定-70%乙醇消毒效果更佳，口腔及创口消毒浓度为0.1%（A错）。